患儿，3岁。咳嗽频作，喉痒声重，痰白稀薄，鼻塞流涕，发热头痛，舌苔薄白，脉浮紧。其治法是
A. 疏风肃肺
B. 散寒宣肺
C. 清肺化痰
D. 解表化痰
E. 温肺化饮

正确答案：B。散寒宣肺

解析：风寒束肺，肺气失宣，肺气上逆，则见咳嗽频作、喉痒声重、痰白清稀，肺开窍于鼻，肺气壅塞，则见鼻塞流涕，风寒侵袭人体，正气与邪气相博，经络不通，则见发热头痛，舌苔薄白，脉浮紧均为风寒之象，治宜疏风散寒，宣肺止咳（B对）。疏风肃肺只祛风邪未祛寒邪（A错）。清肺化痰适于痰热壅肺之证（C错）。解表化痰不够精确，未说明是解风寒之表（D错）。温肺化饮适于寒饮伏肺的小青龙汤证（E错）。